土壤中有毒有害物质过多可破坏土壤的自净过程，主要因为
A. 影响土壤氧化还原状态
B. 影响土壤的环境容量
C. 影响土壤的元素含量
D. 影响土壤微生物的正常生活活动
E. 以上都对

正确答案：E。以上都对

解析：本题考查土壤的自净过程。土壤自净作用是指受污染的土壤通过物理、化学和生物学的作用，使病原体死灭，各种有害物质转化到无害的程度，土壤可逐渐恢复到污染前的状态，这一过程称为土壤自净。土壤中有毒有害物质过多可破坏土壤的自净过程，原因包括：影响土壤氧化还原状态；影响土壤的环境容量；影响土壤的元素含量；影响土壤微生物的正常生物活动（E对ABCD错）。